患者，女，65岁，因乳腺癌接受第二周期化疗。禁用的止吐药物是
A. 甲氧氯普胺
B. 昂丹司琼
C. 地塞米松
D. 苯海拉明
E. 阿瑞匹坦

正确答案：A。甲氧氯普胺

解析：本题考查止吐药。禁用的止吐药物是甲氧氯普胺（A错，为本题正确答案）。癌症患者可选的止吐药物有多巴胺受体阻断剂（如甲氧氯普胺）、5-HT₃受体阻断剂如昂丹司琼（B对）、皮质类固醇如地塞米松（C对）、抗胆碱药和抗组胺药如苯海拉明（D对）及NK-1受体阻断剂如阿瑞匹坦（E对）等，但乳腺癌患者禁用甲氧氯普胺。